某村庄在2016年6～7月发生了细菌性痢疾的流行，在出现单个流行高峰后，接着出现一批病例，表现为流行曲线的拖尾现象，这往往是由于
A. 同源传播后继之以接触传播
B. 连续传播后继之以同源传播
C. 通过接触疫水传播
D. 通过接触生物媒介传播
E. 生物媒介传播和接触疫水传播同时存在

正确答案：A。同源传播后继之以接触传播

解析：本题考查传播途径。传播途径是指病原体从传染源排出后，侵入新的易感宿主前，在外环境中所经历的全过程。细菌性痢疾在出现单个流行高峰后，接着出现一批病例，表现为流行曲线的拖尾现象，这往往是由于同源传播后继之以接触传播（A对BCDE错）。